中药雷公藤制剂广泛用于类风湿关节炎、肾病综合征等疾病的治疗。国家药品不良反应监测中心病例报告显示，雷公藤制剂可引起肝、肾、血液系统和生殖系统等损害。执业药师在进行雷公藤制剂用药指导时，用药建议错误的是
A. 患者服用该类药物时应从最小剂量开始
B. 严格控制用药剂量和疗程，一般连续用药不宜超过3个月
C. 心、肝、肾功能不全者禁用，老年有严重心血管病者慎用
D. 育龄期有孕育要求者，用药时应严格控制剂量和疗程，并密切监测不良反应
E. 用药期间应定期随诊并注意检查血、尿常规，加强心电图和肝肾功能的监测

正确答案：D。育龄期有孕育要求者，用药时应严格控制剂量和疗程，并密切监测不良反应

解析：本题考查的是中成药的不良反应。童、育龄期有孕育要求者、孕妇和哺乳期妇女禁用雷公藤制剂（D错，为本题正确答案）。雷公藤制剂的用药指导：①患者服用该类药物时，必须在医师的指导下使用，用药初期从最小剂量开始（A对）。②严格控制用药剂量和疗程，一般连续用药不宜超过3个月（B对）。③用药期间应定期随诊并注意检查血、尿常规，加强心电图和肝肾功能监测（E对）。④儿童、育龄期有孕育要求者、孕妇和哺乳期妇女禁用；心、肝、肾功能不全者禁用；严重贫血、白细胞和血小板降低者禁用；胃、十二指肠溃疡活动期及严重心律失常者禁用。老年有严重心血管病者慎用（C对）。